硫酸阿托品原料药的含量测定
A. 利用药物的阳离子（BH⁺）与溴甲酚绿阴离子（In⁻）结合成离子对进行测定
B. 样品加冰醋酸10ml和醋酸汞试液4ml后，用高氯酸滴定液滴定
C. 用氯仿提取出药物，加适量醋酐，再用高氯酸滴定液滴定
D. 样品加冰醋酸与醋酐各10ml后，用高氯酸滴定液滴定
E. 样品加水制成每lml约含l6㎍的溶液，在254nm处测定

正确答案：D。样品加冰醋酸与醋酐各10ml后，用高氯酸滴定液滴定

解析：本题考查常用的药品鉴别方法。司可巴比妥钠分子中具有不饱和的双键，可与碘发生加成反应，而使碘溶液的棕黄色褪去（A对）。苯巴比妥分子中具有芳环取代基，可与硫酸-亚硝酸钠反应，反应生成橙黄色产物随即变成橙红色（B错）。
硫喷妥钠中含有硫元素，在氢氧化钠溶液中与铅反应生成白色沉淀，加热后生成硫化铅黑色沉淀（C错）。巴比妥类药物分子中含有丙二酰脲结构，在吡啶溶液中生成烯醇式异构体与铜离子吡啶溶液反应生成紫色配位化合物，含硫化合物显绿色（D错）。含有酚羟基的化合物如阿司匹林与三氯化铁反应呈紫堇色（E错）。